细菌感染的来源不包括
A. 急性或慢性患者
B. 带菌者
C. 病兽
D. 带菌动物
E. 免疫力低下者

正确答案：E。免疫力低下者